为制定血铅的参考值范围，测定了一批正常人的血铅含量，下列说法正确的是
A. 可以制定双侧95％的参考值范围
B. 可以制定，应是单侧上限
C. 可以制定，应是单侧下限
D. 可以制定，但无法确定是上侧还是下侧范围
E. 无法制定，要制定参考值范围必须测定健康人的尿铅含量

正确答案：B。可以制定，应是单侧上限

解析：本题考查医学参考值范围的相关内容。制定参考值范围的步骤：（1）从正常人总体中抽样；（2）控制测量误差；（3）判定是否需要分组确定参考值范围；（4）决定取单侧还是双侧；（5）选定合适的百分界限；（6）根据资料的分布类型选定适当的方法进行参考值范围的估计。由于血铅含量过高为异常，因此应确定参考值范围的单侧上限（B对ACDE错）。